职业性肿瘤的好发部位见于
A. 神经系统
B. 呼吸系统
C. 消化系统
D. 泌尿系统
E. 血液系统

正确答案：B。呼吸系统